Ⅰ型观测线适用于Ⅰ型卡环，其特点是
A. 固位好，稳定和支持作用稍差
B. 固位和稳定好，支持作用稍差
C. 固位和支持作用好，稳定作用稍差
D. 固位、稳定和支持作用都不好
E. 固位、稳定和支持作用都好

正确答案：E。固位、稳定和支持作用都好

解析：一型观测线适用I型铸造或锻丝卡环，亦名I型导线卡环，该卡环固位、稳定和支持作用好。掌握“局部义齿类型，肯氏分类及模型观测”知识点。